患者，10岁。右下后牙进食疼，冷热敏感。检查发现右下第一前磨牙远中龋。探腐质软，稍敏感，无叩痛，无松动。拟采取的治疗措施
A. 局麻下开髓做牙髓治疗
B. 局麻下开髓做活髓切断术
C. 去净腐质，做间接盖髓术
D. 去净腐质，做直接盖髓术
E. 去大部分腐质，安抚治疗

正确答案：E。去大部分腐质，安抚治疗

解析：本病考查龋病的治疗。患者，右下后牙进食疼，冷热敏感。检查发现右下第一前磨牙远中龋（恒牙深龋）。探腐质软，稍敏感（敏感），无叩痛，无松动，综合考虑应去大部分腐质，安抚治疗（E对）。根据临床表现诊断为因深龋引起的可复性牙髓炎，应去除腐质（AB错），近髓有软龋去不净，应氧化锌安抚治疗（CD错），观察，待症状缓解再行永久充填。因为是可复性牙髓炎，是可逆的，年轻恒牙生活力强，恢复性强，以保存活髓为主。